20岁某青年摘除扁桃体后，发热，出现心力衰竭。采血培养细菌，血平板有草绿色溶血环的小菌落形成。涂片染色为革兰阳性链状排列球菌，诊断为甲型溶血性链球菌引起的心内膜炎。试问下列菌中还有哪种菌能形成草绿色溶血环菌落
A. 金黄色葡萄球菌
B. 表皮葡萄球菌
C. 乙型溶血性链球菌
D. 丙型链球菌
E. 肺炎链球菌

正确答案：E。肺炎链球菌